蟾蜍中主要吲哚类生物碱是
A. 石胆酸
B. 强心苷元
C. 5-羟色胺
D. L-3-甲基十五环酮
E. 牛磺熊去氧胆酸

正确答案：C。5-羟色胺

解析：本题考查的是蟾酥的主要化学成分。蟾蜍中主要吲哚类生物碱是5-羟色胺（C对）。蟾酥的化学成分复杂，主要成分有蟾蜍甾二烯类、强心甾烯蟾毒类、吲哚碱类、甾醇类以及肾上腺素、多糖、蛋白质、氨基酸和有机酸等，前两类成分具有强心作用。《中国药典》以蟾毒灵、华蟾酥毒基和脂蟾毒配基为指标成分进行含量测定，要求总量不得少于7.0%。华蟾酥毒基和脂蟾毒配基蟾酥中所含的吲哚类成分有5-羟色胺和5-羟色胺衍生物。蟾酥中游离和结合型的蟾蜍甾二烯类、强心甾烯蟾毒类成分都具有强心苷元（B错）的母核结构。石胆酸（A错）为牛黄的主要化学成分。牛黄约含8%胆汁酸，主要成分为胆酸、去氧胆酸和石胆酸。此外，还含有7%SMC及胆红素，胆固醇，麦角固醇，多种氨基酸（如丙氨酸、甘氨酸、牛磺酸、精氨酸、天冬氨酸、蛋氨酸等）和无机盐等。《中国药典》以胆酸和胆红素为牛黄的质量控制成分，要求胆酸含量不少于4.0%，胆红素含量不得少于25.0%。L-3-甲基十五环酮（D错）为麝香的主要化学成分。麝香的化学成分较为复杂，其中的麝香酮（L-3-甲基十五环酮）是天然麝香的有效成分之一。《中国药典》以麝香酮为指标成分进行含量测定，要求麝香酮含量不得少于2.0%。牛磺熊去氧胆酸（E错）为熊胆的主要化学成分。熊胆的化学成分为胆汁酸类的碱金属盐及胆甾醇和胆红素。从生物活性方面讲，其主要有效成分为牛磺熊去氧胆酸，此外还有鹅去氧胆酸、胆酸和去氧胆酸。